急性肾炎常见于
A. 微小病变
B. 毛细血管内增生性肾炎
C. 系膜增生性肾炎
D. 新月体肾炎
E. 系膜毛细血管性肾炎

正确答案：B。毛细血管内增生性肾炎

解析：急性肾炎常见于毛细血管内增生性肾炎（B对）。光镜下通常为弥漫性肾小球病变，以内皮细胞及系膜细胞增生为主要表现。急进性肾炎病理类型主要为新月体肾炎（D错）。肾病综合征的主要病理类型有微小病变（A错）、局灶节段性肾小球硬化、膜性肾病、系膜增生性肾炎（C错）、系膜毛细血管性肾炎（E错）等。